有关釉质发育不全描述不正确的是
A. 釉质的发育矿化障碍
B. 受局部和全身因素影响
C. 永久性的缺陷
D. 有地区性
E. 牙发育过程中发生的

正确答案：D。有地区性

解析：在牙齿发育期间，由于全身疾病、营养障碍或严重的乳牙根尖周感染，导致的釉质结构异常称为釉质发育不全，没有地区流行性。一般氟斑牙具有地区流行性。掌握“釉质发育不全”知识点。